某男，3岁。过节期间饮食无度，导致恶心呕吐。节后数天厌食、烦躁不安、口渴、脘腹胀满、大便干燥。证属食滞化热，宜选用的成药是
A. 小儿消食片
B. 健脾消食丸
C. 小儿化食丸
D. 一捻金
E. 薯蓣丸

正确答案：C。小儿化食丸

解析：本题考查的是小儿化食丸的主治。某男，3岁。过节期间饮食无度，导致恶心呕吐。节后数天厌食、烦躁不安、口渴、脘腹胀满、大便干燥。证属食滞化热，宜选用的成药是小儿化食丸（C对）。小儿化食丸：【主治】食滞化热所致的积滞，症见厌食、烦躁、恶心呕吐、口渴、脘腹胀满、大便干燥。小儿消食片（A错）：【主治】食滞肠胃所致的积滞，症见食少、便秘、脘腹胀满、面黄肌瘦。健脾消食丸（B错）：【主治】脾胃气虚所致的疳证，症见小儿乳食停滞、脘腹胀满、食欲不振、面黄肌瘦、大便不调。一捻金（D错）：【主治】脾胃不和、痰食阻滞所致的积滞，症见停食停乳、腹胀便秘、痰盛喘咳。薯蓣丸（E错）：【主治】气血两虚，脾肺不足所致的虚劳、胃脘痛、痹病、闭经、月经不调。